发热时，体温上升期机体变化是
A. 体温高于调定点
B. 体温低于调定点
C. 体温与调定点相适应
D. 产热小于散热
E. 产热与散热相等

正确答案：B。体温低于调定点

解析：在体温上升期，由于正调节占优势，使调定点上移，但此时机体的温度低于上移后的调定点（AC错B对），然后机体会出现产热增加，散热减少，产热大于散热（DE错）从而使体温升高。